心脏压力负荷过重的常见原因是
A. 肺动脉高压
B. 室间隔缺损
C. 甲亢
D. 动-静脉瘘
E. 心肌病

正确答案：A。肺动脉高压

解析：心室负荷过重包括容量负荷（收缩前承受的负荷）、压力负荷（射血时克服的阻力）过重。肺动脉高压（A对）时，肺循环阻力增加，右心室射血要克服的阻力增加，心脏压力负荷增加。室间隔缺损（B错）、甲亢（C错）、动-静脉瘘（D错）时，静脉回心血量增加，心室充盈压增加，心脏容量负荷增加。心肌病（E错）时，心肌细胞变性坏死或心肌顺应性减退，导致心肌收缩性降低或心室舒张充盈受限。